“阴虚阳亢”指的是
A. 真虚假实
B. 真实假虚
C. 真寒假热
D. 真热假寒
E. 虚中夹实

正确答案：E。虚中夹实

解析：阴虚阳亢指精血或津液的亏虚，阴气受损，阳气失去制约，阳气亢盛，属于虚中夹实（E对）。真虚假实指病机的本质为“虚”，但表现出“实”的临床假象，又称“至虚有盛候”，如脾气虚弱，运化无力，可见脘腹胀满、疼痛等假实征象（A错）。真实假虚指病机的本质为“实”，但表现出“虚”的临床假象，又称“大实有羸状”，如热结肠胃，一方面出现腹痛硬满拒按，大便秘结，潮热，谵语等症（B错）。真寒假热指阴寒内盛，格阳于外，阴阳寒热格拒而成，又称“阴盛格阳”（C错）。真热假寒指阳热内盛，壅遏于内，格阴于外，而出现内真热外假寒的病机变化，又称“阳盛格阴”（D错）。